《中国药典》制剂通则的片剂项下规定：除另有规定外，片剂应进行的检查项目有
A. 重量差异
B. 溶出度
C. 澄明度
D. 崩解时限
E. 含量均匀度

正确答案：A、B、D、E。重量差异；溶出度；崩解时限；含量均匀度